一项以医院为基础的罕见病的病例对照研究，其符合规定的病例数很少且病例的某种构成特殊，不易找到均衡的对照组，但又必须保证研究效率。选用匹配对照时考虑匹配变量应
A. 匹配个数越大越好
B. 年龄、性别必须匹配
C. 可疑原因也应匹配
D. 注意匹配过度
E. 以上均不考虑

正确答案：D。注意匹配过度